经亚甲蓝染色呈紫色，可用于病原学的鉴别诊断的是
A. 核质
B. 质粒
C. 核糖体
D. 肽聚糖
E. 胞质颗粒

正确答案：E。胞质颗粒

解析：胞质颗粒为细菌贮存的营养物质多糖、脂类及多磷酸盐等。其中异染颗粒为白喉棒状杆菌、鼠疫耶尔森菌和结核分枝杆菌等所特有的胞质颗粒，它由RNA和偏磷酸盐构成，经亚甲蓝染色呈紫色，此着色特点可用于病原学的鉴别诊断。掌握“细菌的大小、形态和基本结构”知识点。